X线片上可发现由牙表面至牙本质浅层的透射影可诊断为
A. 浅龋
B. 中龋
C. 深龋
D. 静止龋
E. 猛性龋

正确答案：B。中龋

解析：中龋的临床检查时已有明显的龋洞，X线片上可发现由牙表面至牙本质浅层的透射影。掌握“龋病的诊断及鉴别诊断”知识点。